某男，19岁。患慢性肾炎8年，日前突发眼睑浮肿，遂来就诊。刻下恶寒、发热、无汗、肢体酸楚、不欲饮水、脉浮滑。医师诊断为风水水肿，治当宣肺利水。处方：麻黄9g，苦杏仁10g，防风6g，浮萍10g，茯苓10g，泽泻10g，车前子15g（包煎），紫苏叶6g（后下）。治疗1月，水肿尽消，患者自行停药。半年后水肿复发，身肿以腰以下为甚，按之凹陷不易恢复，脘腹胀闷、纳减、面色少华、神倦肢冷、小便短少，苔白滑、脉沉细，证属水肿日久、阳气已虚，处方中宜选用的药组是
A. 人参、白术、生姜
B. 附子、白术、茯苓
C. 黄柏、木通、泽泻
D. 茯苓、猪苓、车前子
E. 白茅根、丹参、益母草

正确答案：B。附子、白术、茯苓

解析：本题考查实脾饮的药物组成。患者半年后水肿复发，身肿以腰以下为甚，按之凹陷不易恢复，脘腹胀闷、纳减、面色少华、神倦肢冷、小便短少，苔白滑、脉沉细，证属水肿日久、阳气已虚，患者为水肿之脾阳虚衰证，处方中宜选用的药组是附子、白术、茯苓（B对）。水肿之脾阳虚衰证【症状】身肿日久，腰以下为甚，按之凹陷不易恢复，脘腹胀闷，纳减便溏，面色不华，神疲乏力，四肢倦怠，小便短少。舌质淡，苔白腻或白滑，脉沉缓或沉弱。【方剂应用】基础方剂：实脾饮加减【药物组成】厚朴、木瓜、木香、草果仁、槟榔、附子、白术、茯苓、干姜、炙甘草、生姜、大枣。附子理中丸【药物组成】附子（制）、干姜、党参、白术（A错）（炒）、甘草。【功能】温中健脾。【主治】脾胃虚寒所致的脘腹冷痛、呕吐泄泻、手足不温。龙胆泻肝丸（颗粒、口服液）【药物组成】龙胆、黄芩、栀子（炒）、车前子（盐炒）、泽泻、木通（C错）、当归（酒制）、地黄、柴胡、甘草（炙）。【功能】清肝胆，利湿热。【主治】肝胆湿热所致的头晕目赤、耳鸣耳聋、耳肿疼痛、胁痛口苦、尿赤涩痛、湿热带下。茵陈五苓丸【药物组成】茵陈、茯苓、白术（炒）、泽泻、猪苓（D错）、肉桂。【功能】清湿热，利小便。【主治】肝胆湿热、脾肺郁结所致的黄疸，症见身目发黄、脘腹胀满、小便不利。肾炎康复片【药物组成】人参、西洋参、山药、黑豆、地黄、杜仲(炒）、土茯苓、白花蛇舌草、泽泻、白茅根、丹参、益母草（E错）、桔梗。【功能】益气养阴，健脾补肾，清解余毒。【主治】气阴两虚，脾肾不足，水湿内停所致的体虚浮肿，症见神疲乏力、腰膝酸软、面目四肢浮肿、头晕耳鸣；慢性肾炎、蛋白尿、血尿见上述证候者。